导致呼吸性酸中毒的原因中哪一项例外
A. 呼吸中枢抑制
B. 呼吸道阻塞
C. 甲亢
D. 严重气胸
E. 大量胸腔积液

正确答案：C。甲亢

解析：引起呼吸性酸中毒的原因不外乎外环境CO2浓度过高，或外呼吸通气障碍而致的CO2 排出受阻，呼吸中枢抑制（A对）、呼吸道阻塞（B对）、严重气胸（D对）、大量胸腔积液（E对）都可以发生通气障碍而致的CO2 排出受阻引起呼吸性酸中毒。甲亢（C错，为本题正确答案）时由于血温过高和机体分解代谢亢进可刺激引起呼吸中枢兴奋，通气过度使PaC02 降低，引起呼吸性碱中毒。